新洁尔灭属于哪类消毒剂
A. 表面活性剂
B. 氧化剂
C. 烷基化合物
D. 酚类
E. 醇类

正确答案：A。表面活性剂

解析：本题考查表面活性剂。新洁尔灭即苯扎溴铵的商品名，为阳离子表面活性剂（A对）。氧化剂类（B错）消毒剂有高锰酸钾；烷基化消毒剂（C错）有福尔马林；酚类（D错）消毒剂有苯酚；醇类（E错）消毒剂有乙醇。